下列关于甲状腺功能亢进症的叙述，正确的是
A. T3、T4均增高时，才能诊断
B. T4、T3均降低时，才能诊断
C. 仅有T3增高也可诊断
D. T3增高时，T4则降低
E. 以上均非

正确答案：C。仅有T3增高也可诊断

解析：甲状腺功能亢进症时，T3、T4均增高，或仅有T3增高（BDE错）。T3是诊断甲亢最敏感的指标，T3型甲状腺毒症时仅有TT3增高，故TT3是T3甲状腺毒症的确诊指标，甲状腺功能亢进症仅有T3增高也可诊断（C对）。T4增高（A错）是判断甲状腺功能状态的指标，不如T3敏感。